男，50岁。因高血压，高脂血症服用阿司匹林3个月，1个月来反复出现上腹疼痛，查体：腹软，中上腹压痛，下列治疗药物中首选的
A. 阿莫西林
B. 克拉霉素
C. 奥美拉唑
D. 多潘立酮
E. 硫酸镁

正确答案：C。奥美拉唑

解析：中年男性患者，服用阿司匹林3个月，1个月来反复出现上腹疼痛，综合患者的症状、体征，初步诊断为消化性溃疡，治疗药物首选奥美拉唑（C对）。阿莫西林（A错）、克拉霉素（B错）适用于Hp感染所致慢性胃炎。多潘立酮（D错）是改善胃肠动力药，适用于十二指肠-胃反流。硫酸镁（E错）有导泻、利胆、扩张血管和抗惊厥作用，对消化性溃疡无效。